影响牙槽嵴的吸收速度因素除外的是
A. 缺失原因
B. 牙齿的治疗方式
C. 骨质致密程度
D. 牙槽嵴受力
E. 患者全身健康与骨质代谢情况

正确答案：B。牙齿的治疗方式

解析：牙槽嵴的吸收速度与牙齿的缺失原因、缺牙时间、骨质致密程度、牙槽嵴受力情况，以及患者全身健康与骨质代谢情况有关。掌握“牙列缺失后的病因及影响”知识点。